在血吸虫的生活史中，对人畜具有感染性的阶段是
A. 虫卵
B. 毛蚴
C. 尾蚴
D. 童虫
E. 成虫

正确答案：C。尾蚴